患者，女，34岁产后5天，高热不退，烦渴引饮，大便燥结，恶露不畅，臭秽如脓，小腹疼痛拒按，神昏谵语，舌紫暗，苔黄而燥，脉滑数治疗应首选的方剂是
A. 解毒活血汤
B. 大黄牡丹皮汤
C. 清营汤
D. 安宫牛黄丸
E. 五味消毒饮

正确答案：E。五味消毒饮

解析：患者产后高热不退，是由于感染邪毒，产时产创、出血，元气耗损，血室正开，如接生不慎、产褥不洁、不禁房事，邪毒乘虚侵入，稽留于冲任、胞脉，正邪交争可致发热。恶露不畅，臭秽如脓，小腹疼痛拒按，神昏谵语，舌紫暗，苔黄而燥，脉滑数，均为感染邪毒之证（E对）。解毒活血汤主治温暑痧邪，深入营分，转筋吐下，肢厥汗多，脉伏溺无，口渴腹痛，面黑目陷，势极可危之症（A错）。大黄牡丹皮汤具有泻热破瘀，散结消肿的功效（B错）。清营汤主治热入营分证，身热夜甚，神烦少寐，时有谵语，目常喜开或喜闭，口渴或不渴，斑疹隐隐，脉细数，舌绛而干（C错）。安宫牛黄丸用于热病，邪入心包，高热惊厥，神昏谵语；中风昏迷及脑炎、脑膜炎、中毒性脑病、脑出血、败血症（D错）。